医学道德的作用不包括的是
A. 对医院人际关系的调节作用
B. 对经济效益的保障作用
C. 对医疗质量的保证作用
D. 对医学科学的促进作用
E. 对社会文明的推动作用

正确答案：B。对经济效益的保障作用

解析：道德是由社会的经济基础决定的，以善恶、正当与否、该不该等作为评价标准，借助自律和他律来调节人与人、人与社会、人与自然之间的关系，并追求自身人格完善的活动、关系或意识的总称。道德贯穿在社会生活的各个层面，如社会公德、家庭美德和职业道德等。道德也指个人的道德信念、道德情感、道德品格、道德理想和道德实践。而医学道德则可理解为医院中或行医过程中的道德，因此它可以对医院人际关系有调节作用（A对），对医疗质量有保障作用（C对），对医学科学有促进作用（D对），对社会文明也有推动作用（E对），但是医学道德对经济效益没有保障作用（B错，为本题的正确答案）。